有关SARS患者外周血象的描述，错误的是
A. 白细胞总数正常或偏低
B. 常可见到异型淋巴细胞
C. CD4CD8细胞计数均降低
D. 血小板可减少
E. 常有淋巴细胞计数减少

正确答案：B。常可见到异型淋巴细胞

解析：SARS患者外周血白细胞一般不升高或降低（A对），常有淋巴细胞减少（E对），可有血小板降低（D对），CD⁴⁺T、CD⁸⁺T淋巴细胞均显著降低（C对），提示细胞免疫功能的严重受损，无异型淋巴细胞（B错，为本题正确答案）。